关于药物中杂质的说法，正确的是
A. 药物中绝对不允许存在毒性杂质
B. 药物中不允许存在普通杂质
C. 药物中的杂质均要求测定含量
D. 杂质的限量均用千分之几表示
E. 杂质检查多为限量检查

正确答案：E。杂质检查多为限量检查

解析：本题考查药品中的杂质。关于药物中杂质的说法，正确的是杂质检查多为限量检查（E对）。药物的纯度是相对的，绝对纯净的药物不可能存在。药物中所存在的杂质，在不影响药物的疗效和不影响药物使用安全的前提下，也没有必要完全除去；药物中的杂质通常也不可能完全去除。所以，在保证药物的质量可控和使用安全的前提下，综合考虑药物生产的可行性与产品的稳定性，通常均允许药物中含有一定量的杂质（B错）。一定量药物中所杂质的最大允许量，叫做杂质限量，通常用百之几表示（D错）。药品中的杂质按照毒性分为毒性杂质和普通杂质，毒性杂质是对人体有毒害的杂质，在质量标准中要严格控制，以保证用药安全，而非绝对不允许存在（A错）。限量检查法通常不要求测定其准确含量，只需检查杂质是否超过限量（C错）。